谭某，女，39岁，从微信中得知使用生长因子素（属肽类激素）可以美容，就接连去了多家零售药店后购买，但是一无所获。各家药店对此事有不同解释，正确的是
A. 零售药店断货，需要等几天进货再告知
B. 零售药店不能销售该药品，即使有执业医师处方也不能调配
C. 销售是必须有执业药师指导使用，但执业药师正好不在岗，无法销售
D. 需要凭执业医师处方才能调配，由于没有医师处方，故不能调配

正确答案：B。零售药店不能销售该药品，即使有执业医师处方也不能调配

解析：本题考查的是药品零售企业不得经营的药品种类。谭某，女，39岁，从微信中得知使用生长因子素（属肽类激素）可以美容，就接连去了多家零售药店后购买，但是一无所获。各家药店对此事有不同解释，正确的是零售药店不能销售该药品，即使有执业医师处方也不能调配（B对）。药品零售企业不得经营的药品种类：药品零售企业不得经营的药品：麻醉药品、放射性药品、第一类精神药品、终止妊娠药品（包括含有“米非司酮”成分的所有药品制剂）、蛋白同化制剂、肽类激素（胰岛素除外）、药品类易制毒化学品、疫苗，以及我国法律法规规定的其他禁止零售的药品。药品零售企业也不得经营中药配方颗粒、医疗机构制剂。药品零售企业可不凭医师处方销售非处方药，但执业药师或其他药学技术人员应当向个人消费者提供必要的药学服务，指导其合理用药或提出寻求医师治疗的建议。销售乙类非处方药时，执业药师或其他药学技术人员应当根据个人消费者咨询需求，提供科学合理的用药指导；销售甲类非处方药时，执业药师应当主动向个人消费者提供用药指导（C错）。根据《关于做好处方药与非处方药分类管理实施工作的通知》（国食药监安〔2005〕409号）的规定，对于部分滥用或超剂量使用会带来较大的安全性风险的药品，药品零售企业必须做到严格凭处方销售。此类药品包括所有注射剂、医疗用毒性药品、第二类精神药品、禁止零售的药品以外其他按兴奋剂管理的药品、精神障碍治疗药（抗精神病、抗焦虑、抗躁狂、抗抑郁药）、抗病毒药（逆转录酶抑制剂和蛋白酶抑制剂）、肿瘤治疗药、含麻醉药品的复方口服溶液和曲马多制剂、未列入非处方药目录的抗菌药物和激素，以及国家药品监督管理局公布的其他必须凭处方销售的药品（D错）。